患儿，3岁。智力不全，精神呆滞，言语不清晰，肌肤苍白，发稀萎黄，大便秘结，舌光无苔。治疗应首选
A. 八珍汤
B. 归脾汤
C. 左归丸
D. 菖蒲丸
E. 右归丸

正确答案：D。菖蒲丸

解析：患儿3岁智力不全，精神呆滞，言语不清晰，当属五迟之语迟，此为小儿生长发育障碍的病症，指立迟、行迟、齿迟、发迟、语迟。心主神明，心气虚弱，神气不足，故智力不全、精神呆滞，心之声为言，心气不足，神窍不利，故言语不清晰，心血不足，不能华色，故肌肤苍白，发为血之余，血不足则不能充养，故发稀疏而萎黄，血不润肠则见大便秘结，舌光无苔为心之血虚气弱之象，治以菖蒲丸，可补心养血（D对）。八珍汤气血双补，且以入脾胃为主（A错）。归脾汤重在健脾益气，养心安神，其益智之力无菖蒲丸强（B错）。左归丸填补真阴，善于治疗腰膝酸软，骨蒸盗汗，头晕耳鸣之症（C错）。右归丸填补真阳，善于治疗腰膝酸软，四肢不温，畏寒，夜尿频多等症（E错）。